下列哪一种休克不属于低血容量性休克
A. 失血性休克
B. 烧伤性休克
C. 失液性休克
D. 感染性休克
E. 挤压伤性休克

正确答案：D。感染性休克

解析：低血容量性休克主要包括失血失液性休克（AC对）、烧伤性休克（B对）和创伤性休克。挤压伤性休克（E对）属于创伤性休克。感染性休克（D错，为本题正确答案）不属于低血容量性休克。